有机物（卤代烃等）在水环境中最重要的化学转化反应是
A. 水解反应
B. 络合反应
C. 中和反应
D. 氧化反应
E. 还原反应

正确答案：A。水解反应

解析：本题考查化学转化反应。化学转化主要通过水解、化合、氧化还原等作用来实现。水解反应（A对BCDE错）是有机物（卤代烃等）在水环境中最重要的化学转化反应。